增长年龄（或称可达到年龄）与评价年龄之差表示
A. 危险因素已经存在的年数
B. 降低危险因素的严重程度后可能延长寿命的年数
C. 消除危险因素所需要的年数
D. 接触危险因素后引发疾病所需要的年数
E. 接触危险因素后从患病到死亡的年数

正确答案：B。降低危险因素的严重程度后可能延长寿命的年数